T₁乳腺癌其肿块最长径不超过
A. 1cm
B. 2cm
C. 3cm
D. 4cm
E. 5cm

正确答案：B。2cm

解析：乳腺癌原发癌瘤分期如下：T0：原发癌瘤未查出。Tis：原位癌（非浸润性癌及未查到肿块的乳头湿疹样乳腺癌）。T1：癌瘤长径≤2cm（B对）。T2：2cm＜癌瘤长径≤5cm（E错）。T3：癌瘤长径＞5cm。T4：癌瘤大小不计，但侵及皮肤或胸壁（肋骨、肋间肌、前锯肌），炎性乳腺癌亦属之。